判断抗精神病药是否有效需在足剂量下使用至少
A. 2周
B. 3周
C. 4周
D. 5周
E. 6周

正确答案：C。4周

解析：判断一种抗精神病药是否有效至少要足量使用4～6周，数据经常考，请牢记（C对）。